发热的体温上升期有
A. 产热正常，散热减少
B. 产热增多，散热减少
C. 产热与散热都增多
D. 产热减少，散热减少
E. 产热减少，散热增多

正确答案：B。产热增多，散热减少

解析：发热的体温上升期调定点上移，产热增多，散热减少（B对），调节体温升高是此期的热代谢特点。产热减少，散热增多（E错）是退热期的热代谢特点。产热与散热都增多（C错）是高温持续期的热代谢特点。在发热过程的三个时期中一般没有A、D选项的相关说法。